属于刺激性泻药的是
A. 甘油（开塞露）
B. 聚乙二醇4000
C. 乳果糖
D. 酚酞
E. 硫酸镁

正确答案：D。酚酞

解析：本题考查泻药。酚酞（D对）为刺激性泻药。泻药包括容积性泻药、渗透性泻药、刺激性泻药、润滑性泻药、膨胀性泻药、肠道清洗剂及促胃肠动力药。甘油（A错）为润滑性泻药；聚乙二醇4000（B错）为膨胀性泻药；乳果糖（C错）系人工合成的不吸收性双糖，是一种渗透性泻药；硫酸镁（E错）为容积性泻药。